在土壤中施入下列哪种物质，可以减少植物对硒的吸收
A. 草木灰
B. 碳酸钙
C. 碳酸胺
D. 农家肥
E. 尿素

正确答案：B。碳酸钙

解析：本题考查硒的相关内容。在高硒土壤中施入碳酸钙（B对ACDE错）、氧化钡等物质，可以减少植物对硒的吸收。